SARS的传播途径是
A. 直接接触患者的呼吸道分泌物
B. 水、食物
C. 蚊虫
D. 土壤
E. 母婴

正确答案：A。直接接触患者的呼吸道分泌物

解析：SARS患者为其主要传染源，主要通过短距离飞沫、直接接触患者呼吸道分泌物（A对）及密切接触传播；尚无证据表明水、食物（B错），苍蝇、蚊虫（C错）蟑螂等媒介昆虫可以传播SARS～CoV。尚无经过土壤（D错）、血液途径、性途径传播和母婴（E错）垂直传播的流行病学证据。